男婴，1岁半，口内检查发现，上下颌乳中切牙和乳侧切牙萌出，按照一般乳牙萌出顺序在其口内萌出的下一颗牙为
A. 下颌乳尖牙
B. 上颌乳尖牙
C. 下颌第一乳磨牙
D. 上颌第一乳磨牙
E. 下颌第二乳磨牙

正确答案：C。下颌第一乳磨牙

解析：在乳中切牙与乳侧切牙萌出后，应该是下颌第一乳磨牙萌出。乳牙萌出顺序为：Ⅰ、Ⅱ、Ⅳ、Ⅲ、Ⅴ。下颌牙的萌出较上颌同名牙略早。掌握“牙的萌出、更替及牙体解剖名词、标志”知识点。